对于弱酸性或弱碱性有机化合物，只有pH条件合适，才易发挥毒性效应
A. 脂/水分配系数与毒效应
B. 电离度与毒效应
C. 挥发度和蒸汽压与毒效应
D. 分散度与毒效应
E. 纯度与毒效应

正确答案：B。电离度与毒效应